男，22岁。饥饿性上腹痛伴反酸1月余。2小时前呕血1次，暗红色，量约200ml。体重无明显变化。否认慢性肝病史。查体：贫血貌，腹软，上腹部有压痛，无反跳痛，肝脾肋下未触及最有助于确诊的检查是
A. 腹腔血管造影
B. 腹部CT
C. 腹部B超
D. 胃镜
E. 腹部X线平片

正确答案：D。胃镜

解析：青年男性，无肝病史，呕血200ml，饥饿性上腹痛（十二指肠溃疡典型症状），应考虑十二指肠溃疡引起上消化道大出血。胃镜（D对）可直视病变部位、诊断阳性率高，并可同时行止血治疗，是最有助于确诊的检查。腹腔血管造影（A错）可帮助确定出血部位，但操作较繁琐，属有创检查，不作为首选。腹部CT（B错）、腹部B超（C错）对于诊断十二指肠溃疡出血没有帮助。腹部X线平片（E错）对诊断肠穿孔有一定意义，可见膈下新月状阴影，但对于确定穿孔部位意义不大。